治疗热淋，小便涩痛，其功效是
A. 祛风散寒除湿
B. 燥湿健脾
C. 清热解毒，排脓
D. 回阳，温肺化痰
E. 清热利尿通淋

正确答案：E。清热利尿通淋

解析：祛风寒湿药具有较好的祛风、除湿、散寒、止痛、通经络等作用，治疗风寒湿痹，肢体关节疼痛，痛有定处，遇寒加重等（A错）。化湿药以化湿运脾为主要作用，治疗湿阻中焦证，称为化湿药。脾喜燥而恶湿，“土爱暖而喜芳香”。本类药物辛香温燥，主入脾、胃经，芳香之品能醒脾化湿，温燥之药可燥湿健脾（B错）。清热解毒药鱼腥草的功效为清热解毒，消痈排脓，利尿通淋。治疗肺痈吐脓，痰热喘咳，疮痈肿毒（C错）。温里药干姜功效为温中散寒，回阳通脉，温肺化饮。治疗脾胃寒证，脘腹冷痛，呕吐泄泻，亡阳证，肢冷脉微，寒饮喘咳（D错）。